在工农业生产中常见的单纯窒息性气体有
A. 氮气
B. 甲烷
C. CO₂
D. 水蒸气
E. 以上都是

正确答案：E。以上都是